在克山病区人群膳食中，下列哪种元素可促进硒的排泄
A. 氟
B. 钼
C. 钙
D. 碘
E. 锰

正确答案：E。锰

解析：本题考查硒的相关内容。克山病是一种与环境低硒有关、多病因综合所导致的地方性心肌病。在克山病区人群膳食中，锰元素（E对ABCD错）可促进硒的排泄。